常作为急性毒性试验中选择剂量范围依据的是
A. LD₀和LD₅₀
B. LD₀和LD₁₀₀
C. LD₀₁和LD₅₀
D. LD₀₁和LD₁₀₀

正确答案：B。LD₀和LD₁₀₀

解析：本题考查急性毒性试验中选择剂量范围的依据。常作为急性毒性试验中选择剂量范围依据的是LD₀和LD₁₀₀（B对ACD错）。LD₀即最大耐受剂量，指一组受试实验动物中，不引起动物死亡的最大剂量。LD₁₀₀即绝对致死剂量，指引起一组受试实验动物全部死亡的最低剂量。